介导主要组织相容复合体（MHC）非限制杀伤的细胞是
A. CTL细胞
B. B细胞
C. NK细胞
D. 浆细胞
E. 肥大细胞

正确答案：C。NK细胞

解析：NK细胞（C对）杀伤靶细胞没有MHC限制性，以‘自我丢失’识别模式识别病毒感染靶细胞和突变细胞。CTL细胞（A错）为细胞毒T淋巴细胞，通过细胞毒作用特异性杀伤病毒等胞内感染病原体所感染的靶细胞和体内突变的细胞。B细胞（B错）通过抗体发挥特异性体液免疫功能，同时也是重要的抗原提呈细胞，并参与免疫调节。浆细胞（D错）又称抗体形成细胞，是B细胞分化的终末细胞，能合成和分泌特异性抗体。肥大细胞（E错）通过脱颗粒可释放和合成一系列炎性介质（组胺、白三烯、前列腺素D2等）和促炎细胞因子（IL-1、IL-4、IL-8和TNF等）引发炎症反应，从而在机体抗感染、抗肿瘤和免疫调节中发挥重要作用。